急性胰腺炎患者血清淀粉酶值的高峰出现在发病后
A. 12小时
B. 8小时
C. 48小时
D. 24小时
E. 4小时

正确答案：D。24小时

解析：血清、尿淀粉酶测定是急性胰腺炎最常用的诊断方法。急性胰腺炎患者血清淀粉酶值的高峰出现在发病后24小时（D对）；尿淀粉酶值的高峰出现在发病后48小时。